伤残调整寿命年是指
A. 因早死所致的寿命损失年
B. 因伤残所致的寿命损失年
C. 因伤残而存活的寿命年
D. 从发病到死亡所损失的全部健康寿命年
E. 以上均不正确

正确答案：D。从发病到死亡所损失的全部健康寿命年

解析：本题考查伤残调整寿命年的概念。伤残调整寿命年是指从发病到死亡所损失的全部健康寿命年（D对ABCE错），包括因早死所致的寿命损失年和疾病所致伤残引起的健康寿命损失年两部分。